湿邪致病可见尿少，水肿等症的主要原因是
A. 湿性重浊，分泌物秽浊不清
B. 湿性黏滞，排泄物涩滞不畅
C. 湿性黏滞，疾病缠绵难愈
D. 湿性趋下，其水肿以下肢明显
E. 湿为阴邪，易阻气机，损伤阳气

正确答案：D。湿性趋下，其水肿以下肢明显

解析：湿性趋下，易袭阴位。湿邪类水属阴而有趋下之势，故湿邪为病，多易伤及人体下部。如水肿、湿疹、脚气等病，以下肢较为多见（D对）。湿邪为患，易出现分泌物和排泄物秽浊不清的特征。如湿浊在上，则面垢、眵多；湿浊下注，则小便浑浊或滞涩不利、妇女白带过多；湿滞大肠，则大便溏泄、下痢脓血；湿邪浸淫肌肤，则可见湿疹浸淫流水等（A错）。湿邪为患，易呈现分泌物和排泄物黏滞不爽的特征，如湿热痢疾的大便排泄不爽，淋证的小便滞涩不畅，以及汗出而黏、口黏和舌苔厚滑黏腻等（B错）。因湿性黏滞，易阻气机，气不行则湿不化，胶着难解，故湿邪为病，起病隐缓，病程较长，反复发作，或缠绵难愈。如湿温、湿疹、湿痹（着痹）等，皆因其湿邪难除而不易速愈，或反复发作（C错）。湿邪伤人常留滞于脏腑经络，阻遏气机，使脏腑气机升降失常，经络阻滞不畅，如湿阻胸膈，气机不畅则胸膈满闷；湿阻中焦，脾胃气机升降失常，纳运失司，则脘痞腹胀，食欲减退；湿停下焦，肾与膀胱气机不利，则小腹胀满、小便淋涩不畅等（E错）。